最容易出现缺血性骨坏死的骨折是
A. 股骨颈骨折
B. 股骨转子间骨折
C. 胫骨干骨折
D. 桡骨远断骨折
E. 肱骨外科颈骨折

正确答案：A。股骨颈骨折

解析：最容易出现缺血性骨坏死的骨折是股骨颈骨折（A对）。